吗啡的外周作用是
A. 松弛胃肠道平滑肌
B. 促进肠道腺体分泌
C. 收缩膀胱括约肌
D. 收缩外周血管引起血压升高
E. 收缩脑血管引起颅内压降低

正确答案：C。收缩膀胱括约肌

解析：治疗量吗啡的外周作用是提高膀胱括约肌的张力和膀胱容积，收缩膀胱括约肌（C对），引起排尿困。难疗量的吗啡可兴奋胃肠道平滑肌（A错），增加胃窦张力，减慢胃排空速度，增加小肠和结肠的张力，使推进型蠕动减弱，延缓肠内容物的排出。吗啡能够抑制肠道腺体分泌（B错），减少胰液、肠液和胆汁分泌，同时对中枢神经系统有抑制作用，引起便意迟钝而引起便秘。吗啡可促进组胺的释放，能扩张动脉和静脉，外周血管阻力降低，可引起体位性低血压（D错）。吗啡抑制呼吸作用引起体内二氧化碳的积聚，可使脑血管扩张，颅内压升高（E错）。